关于麻疹流行病学下述错误的是
A. 麻疹患者是唯一传染源
B. 出疹前5天至出疹后5天均有传染性
C. 病毒存在于眼结膜、鼻、口咽和气管等分泌物中
D. 通过喷嚏、咳嗽等由飞沫传播
E. 也可通过粪便传播

正确答案：E。也可通过粪便传播